女性，15岁。呕吐腹泻1天，大便4~5次，呈水样或糊状，无黏液及脓血，排便前腹痛，便后缓解，发病前曾在路边小摊上吃冷面一碗。体检：腹软，脐周轻度压痛，肠鸣音活跃，粪检：WBC10个/HP，RBC少许，腹泻的原因可能为
A. 胃泌素瘤
B. 甲状腺功能亢进
C. 霍乱
D. 吸收不良综合征
E. 急性胃肠炎

正确答案：E。急性胃肠炎